患儿，男，出生时Apgar评分4分，生后2天嗜睡，肌张力减退，瞳孔缩小，时而出现惊厥，头颅CT扫描，可见右叶有低密度影。该患儿临床诊断最大可能为
A. 新生儿窒息
B. 新生儿缺氧缺血性脑病
C. 新生儿蛛网膜下腔出血
D. 新生儿硬膜下出血
E. 胆红素脑病（核黄疸）

正确答案：B。新生儿缺氧缺血性脑病

解析：患儿，出生时Apgar评分4分（提示出生时新生儿轻度窒息），生后2天嗜睡，肌张力减退，瞳孔缩小（新生儿缺氧缺血性脑病的典型临床表现），时而出现惊厥（提示重度），头颅CT扫描，可见右叶有低密度影，根据患儿的病史、临床症状、体征及实验室检查，考虑最可能的诊断为新生儿缺氧缺血性脑病（B对），指围生期窒息引起的部分或完全缺氧、脑血流减少或暂停而导致胎儿或新生儿脑损伤。新生儿窒息（A错）是指新生儿出生后不能建立正常的自主呼吸而导致低氧血症、碳酸血症及全身多脏器损伤，该患儿已出生2天。新生儿蛛网膜下腔出血（C错）及新生儿硬膜下出血（D错）在CT上表现为相应部位的高密度影。胆红素脑病（E错）为新生儿溶血病最严重的并发症，患儿多于生后4 -7天出现症状。